经乱无期，出血淋漓不尽，色鲜红，质稍稠，头晕耳鸣，腰膝酸软。治疗应首选
A. 固阴煎
B. 六味地黄丸
C. 大补元煎
D. 左归丸
E. 归肾丸

正确答案：D。左归丸

解析：肾阴偏虚，虚火内生，损伤阴络，冲任失调，血海蓄溢无常，故见经乱无期；虚火灼伤血络，故见出血淋漓不尽；阴虚阳动，故色鲜红，质稍稠；头晕耳鸣，腰膝酸软均为肾阴虚损之征；其病机是肾阴亏虚，虚火内生，损伤阴络，冲任失调；治宜滋肾养阴，调经止血；选用滋阴补肾，填精益髓的左归丸（D对）。固阴煎用于治疗月经先后不定期的肾虚证（A错）。